促进造血干细胞增生分化的细胞因子是
A. IL-2
B. IFN-r
C. IL-4
D. SCF
E. IL-10

正确答案：D。SCF

解析：干细胞因子（SCF）促进造血干细胞和组细胞增生分化，促进肥大细胞存活、增殖和活化。掌握“细胞因子及受体”知识点。